高血压患者的饮食注意下列哪项是错误的
A. 控制能量的摄入，提倡吃复合糖类
B. 以不饱和脂肪酸和亚油酸为主
C. 多饮食高蛋白
D. 饮食钾、钙丰富而钠低的食品
E. 严格控制盐的摄入量

正确答案：C。多饮食高蛋白

解析：高血压是多因素、多环节、多阶段和个体差异性较大的疾病。其中饮食为常见的与高血压发病有关的因素，高蛋白质摄入属于升压因素，因此高血压患者不宜饮食高蛋白食物（C错，为本题正确答案）。饮食中饱和脂肪酸或饱和脂肪酸/多不饱和脂肪酸比值较高也属于升压因素，故高血压患者饮食脂肪类应以不饱和脂肪酸和亚油酸为主（B错）。不同地区人群血压水平和高血压患病率与钠盐平均摄入量显著正相关，但钾摄入量与血压呈负相关。因此高血压患者应严格控制盐的摄入量（E错），并可多饮食钾钙丰富而钠低的食品（D错），如新鲜蔬菜和水果。体重降低对改善胰岛素抵抗、糖尿病、血脂异常和左心室肥厚均有益，高血压患者控制能量的摄入，减轻体重，提倡吃复合糖类（A错）。